28岁不孕妇女，痛经3年且逐渐加重。查子宫后壁有2个触痛性硬韧结节，右侧附件区扪及超鸭卵大活动不良囊性肿物，压痛不明显.为进一步确诊，最有价值的辅助检查方法是
A. 腹部X线摄片
B. 盆腔B型超声检查
C. 诊断性刮宫活组织检查
D. 子宫输卵管碘油造影
E. 腹腔镜检查

正确答案：E。腹腔镜检查

解析：该患者为育龄期不孕妇女（育龄期是子宫内膜异位症的高发年龄，40%的内异症患者不孕），痛经3年且逐渐加重，子宫后壁有2个触痛性硬韧结节，右侧附件区扪及超鸭卵大活动不良囊性肿物，压痛不明显，（双合诊检查时，可发现子宫后倾固定，直肠子宫陷凹、宫底韧带或子宫后壁下方可扪及触痛性结节，一侧或双侧附件处触及囊实性包块，活动度差），诊断为子宫内膜异位症，最有价值的辅助检查方法是腹腔镜检查（E对），其是确诊盆腔内异症的标准方法。腹部X线摄片（A错）一般适用于骨骼的检查。盆腔B型超声检查（P271）（B错）是诊断卵巢异位囊肿和膀胱、直肠内异症的重要方法，可确定异位囊肿位置、大小和形状，但因囊肿回声图像无特异性，不能单纯依靠B型超声图像确诊。诊断性刮宫活组织检查（C错）主要用于子宫内膜病变的检查。子宫输卵管碘油造影（D错）多用于输卵管通畅度检查。